男孩最终身高高于女孩的主要原因是
A. 男孩发育水平高于女孩
B. 男孩发育比女孩晚，但发育时间长，幅度大
C. 男孩体育运动量大
D. 男孩瘦体重多，生长快
E. 以上都不是

正确答案：B。男孩发育比女孩晚，但发育时间长，幅度大

解析：本题考查体格生长规律的相关内容。由于男孩青春期身高增长高峰出现的时间比女孩晚，骨骼停止生长的时间也相应晚，加之男孩每年身高的增长值幅度大，持续时间长（B对ACDE错），故到最终时男性的身高一般比女性高。